横切面韧皮部有红棕色或黑棕色分泌物，与木部相间排列呈3----8个偏心性半圆形环，髓部偏向一侧的中药材是
A. 大血藤
B. 鸡血藤
C. 川木通
D. 牛膝
E. 降香

正确答案：B。鸡血藤